关于常用化学消毒剂的说法错误的是
A. 高效消毒剂是可杀灭包括细菌芽胞在内的所有种类微生物的消毒剂
B. 中效消毒剂不能杀灭细菌芽胞
C. 低效消毒剂不能杀灭细菌芽胞、结核分枝杆菌及抵抗力较强的某些真菌和病毒
D. 苯扎溴铵属于高效消毒剂
E. 碘酊属于中效消毒剂

正确答案：D。苯扎溴铵属于高效消毒剂

解析：按照杀灭微生物的强度，将消毒剂分为三大类：①高效消毒剂，可杀灭包括细菌芽胞在内的所有种类微生物的消毒剂；②中效消毒剂，可杀灭包括结核分枝杆菌在内的细菌繁殖体和大多数种类的真菌及病毒，但不能杀灭细菌芽胞的消毒剂，如碘酊；③低效消毒剂，可杀灭多种细菌繁殖体，但不能杀灭细菌芽胞、结核分枝杆菌及抵抗力较强的某些真菌和病毒的消毒剂，苯扎溴铵。掌握“消毒与灭菌”知识点。